关于Lissauer’s束,何项说法错误
A. 亦称背外侧束
B. 后根纤维在其内上下行1-2个节段
C. 束内有来自II层神经元的轴突
D. 也就是脊髓小脑后束
E. 有节段间联系的作用

正确答案：D。也就是脊髓小脑后束

解析：Lissauer束又称为背外侧束（A对D错，为本题正确选项），主要由细的无髓和有髓纤维组成，这些纤维进入脊髓上升或下降1-2节段（B对），在胶状质背外侧聚集，欧节段间联系的作用（E对）。